外科急诊不适合作内镜检查的是
A. 上消化道出血
B. 下消化道出血
C. 梗阻性黄疽
D. 上消化道异物
E. 多种炎性急腹痛

正确答案：E。多种炎性急腹痛

解析：内镜检查多适合空腔器官，炎性急腹痛是由腹部器官或组织发生炎症引起的腹痛，如急性胃肠炎、胰腺炎、胆囊炎、阑尾炎等，因此并不是所有的炎性腹痛（E对）都适合内镜检查（如胰腺炎）。上、下消化道出血（AB错）时，经内镜检查不但可发现出血点确定诊断，还可进行相应的止血治疗。梗阻性黄疸（C错）可行内镜逆行胰胆管造影确诊。上消化道异物（D错）可行内镜检查并经内镜取出异物。